乔某，30岁。两年前第1次怀孕，因早孕时服药做了人工流产。一年后第2次怀孕，2个月时不完全自然流产，而行刮宫术，流产后不到半年第3次怀孕(本次)。早孕期曾有少量阴道出血，经保胎治疗好转。1991年10月15日孕足月临产，在家自然分娩出一6斤男婴。胎儿娩出后半小时，胎盘仍未娩出。接生员反复用力牵拉脐带，挤压宫底，胎盘未出来，却出现大量阴道出血，产妇最后因失血性休克死亡。该产妇出血的可能原因是
A. 胎盘娩出不全
B. 宫缩乏力
C. 软产道裂伤
D. 凝血功能障碍
E. 胎盘粘连

正确答案：E。胎盘粘连